能引起急性腹痛的是
A. 流产
B. 异位妊娠
C. 早产
D. 妊娠高血压综合征
E. 前置胎盘

正确答案：B。异位妊娠

解析：能引起急性腹痛的是异位妊娠（B对），当发生输卵管妊娠流产或破裂，突然出现撕裂样剧痛，自下腹一侧开始向全腹扩散。流产（P48）（A错）主要表现为停经后阴道流血和腹痛，腹痛表现为下腹中央阵发性坠痛。妊娠高血压综合征（P64）（D错）主要临床表现为妊娠期出现高血压，较重时出现蛋白尿，严重时发生抽搐，可出现腹部不适或持续性上腹部疼痛（为肝包膜下血肿或肝破裂症状），但不是急性发作。前置胎盘（P126）（E错）的典型症状为妊娠晚期或临产时，发生无诱因、无痛性反复阴道流血。